患者一下颌第二磨牙，邻（牙合）面银汞充填，剩余颊舌壁硬组织强壮，但牙冠高度仅约4mm，若全冠修复，以下增加固位的措施哪项是错误的
A. 龈下边缘
B. 适当增加龈边缘宽度
C. 设计嵌体冠
D. 增加钉洞或箱型辅助固位形
E. 以上都不是

正确答案：E。以上都不是

解析：本题考查全冠修复增加固位的措施。该患者牙冠高度仅4mm，设计龈下边缘（A对）可以提高（牙合）龈高度以增加固位。适当增加龈边缘宽度（B对）可以提高边缘密合度和接触面积以增加固位。该患者是邻（牙合）面缺损，剩余颊舌壁硬组织强壮，符合嵌体冠（C对）的条件，设计嵌体冠有利于增加固位。增加钉洞或箱型辅助固位形（D对）既增加了约束力，也增加了接触面积，有利于增加固位。（E错，为本题的正确答案）。